治疗呼吸衰竭脾肺气虚，湿痰蒙蔽证，应首选
A. 六君子汤合导痰汤
B. 圣愈汤合涤痰汤
C. 生脉散合黄连温胆汤
D. 保元汤合温胆汤
E. 肾气丸合涤痰汤

正确答案：A。六君子汤合导痰汤

解析：呼吸衰竭脾肺气虚，湿痰蒙蔽证治宜补气健脾，化痰除湿，选用六君子汤益气健脾，燥湿化痰联合燥湿豁痰，行气开郁的导痰汤最为适宜（A对）。圣愈汤补气、补血、摄血联合豁痰开窍的涤痰汤适用于气虚亏虚，痰浊瘀闭之证（B错）。生脉散合黄连温胆汤功用益气养阴，清热化痰适用于治疗呼吸衰竭气阴两虚，痰热扰心证（C错）。保元汤养血安神，补血安胎，除热生津，温胆汤理气化痰，二者合用适用于血虚痰凝之证（D错）。肾气丸有补肾助阳之功效合用豁痰开窍的涤痰汤适用于肾阳不足，痰浊瘀闭之证（E错）。